百日咳防疫措施
A. 隔离病人
B. 终末消毒
C. 两者均要
D. 两者均不要

正确答案：A。隔离病人

解析：本题考查百日咳的防疫措施。百日咳属于经空气传播的传染病，传染病的防疫应从控制传染源、切断传播途径、保护易感人群入手。其中控制传染源主要是对病人进行隔离（A对BCD错）。切断传播途径主要是注意个人卫生，避免与病人接触。保护易感人群主要通过人工自动免疫、人工被动免疫等途径。